学校卫生标准规定，小学3-6年级学生睡眠时间不宜少于
A. 6小时
B. 7小时
C. 8小时
D. 9小时
E. 10小时

正确答案：D。9小时